最易形成潜伏感染的病原体是
A. HIV
B. HBV
C. HAV
D. HSV
E. HPV

正确答案：D。HSV

解析：最易形成潜伏感染的病原体是单纯疱疹病毒（HSV）。掌握“病毒传播方式、感染类型、致病机制及免疫”知识点。